急性肾炎使用青霉素的目的是
A. 防止并发症
B. 消除水肿
C. 控制肾脏炎症
D. 清除体内残存的链球菌
E. 预防感染

正确答案：D。清除体内残存的链球菌

解析：急性肾炎使用青霉素的目的是抗感染，有链球菌感染灶者应用青霉素10～14天，以彻底清除体内病灶中残余细菌，减轻抗原抗体反应（D对）。